在与矽肺发病直接有关下列因素中哪项是最重要的
A. 游离Si0₂含量
B. 粉尘浓度
C. 接尘工龄
D. 防护措施
E. 个体素质条件

正确答案：A。游离Si0₂含量

解析：本题考查矽肺发病与下列因素有关：粉尘中游离SiO₂含量（A对BCDE错）、SiO₂类型、粉尘浓度、分散度、接尘工龄、防护措施、接触者个体因素。其中，粉尘中游离SiO₂含量是影响矽肺发病的最重要因素，游离SiO₂越高，发病时间越短，病变越严重。